初产妇，25岁，39周。规律宫缩10小时，宫口开全2小时，宫缩良好，阴道检查LOT位，S+3，骨盆正常，胎心150次/分。正确处理是
A. 静脉滴注缩宫素
B. 徒手旋转胎头后自然分娩
C. 剖宫产
D. 立即产钳助产
E. 立即胎吸助产

正确答案：B。徒手旋转胎头后自然分娩

解析：初产妇，25岁，妊娠39周。规律宫缩10小时，宫口开全2小时，宫缩良好，阴道检查LOT位（枕左横位），S+3，骨盆正常，胎心150，应诊断为胎位异常（持续性枕横位）。枕横位下降过程中内旋受阻，成为持续性枕横位时，需用手或胎头吸引术将胎头转成枕前位，然后胎头继续下降，进行阴道分娩（B对）。若自然分娩困难，可行阴道产钳助产术（DE错）。静脉滴注缩宫素（A错）适用于协调性宫缩乏力、宫口扩张≥3cm、胎心良好、胎位正常、头盆相称者。若S≤+2，才考虑行剖宫产术（C错）。